GMP表示
A. 危害分析关键控制点
B. 食品良好生产规范
C. 食品添加剂标准
D. 食品质量合格证
E. 保健食品合格证

正确答案：B。食品良好生产规范